苦参碱是
A. 简单异喹啉类生物碱
B. 苄基异喹啉类生物碱
C. 原小檗碱型
D. 色胺吲哚类生物碱
E. 双稠哌啶生物碱

正确答案：E。双稠哌啶生物碱

解析：本题考查的是生物碱的分类。苦参碱是双稠哌啶类生物碱（E对）。双稠哌啶类生物碱：由两个哌啶环共用一个氮原子稠合而成的杂环，具喹喏里西啶的基本母核。主要分布于豆科、石松科和千屈菜科。如苦参中的苦参碱、氧化苦参碱，野决明中的金雀花碱等。简单吡啶类（A错）生物碱：此类生物碱分子较小，结构简单，很多呈液态。如槟榔中的槟榔碱、槟榔次碱，烟草中的烟碱，胡椒中的胡椒碱等。苄基异喹啉类（B错）生物碱：又分为1-苄基异喹啉类和双苄基异喹啉类。①1-苄基异喹啉类：为异喹啉母核1位连有苄基的一类生物碱。如罂粟中具解痉作用的罂粟碱，乌头中的强心成分去甲乌药碱，厚朴中的厚朴碱等。②双苄基异喹啉类：为两个苄基异喹啉通过1～3个醚键相连接的一类生物碱。如存在于防己科北豆根中的主要酚性生物碱蝙蝠葛碱，汉防己中的汉防己甲素和汉防己乙素，十大功劳中的异汉防己甲素。原小檗碱类（C错）生物碱：可以看成由两个异喹啉环稠合而成。依据两者结构母核中D环氧化程度不同，又分为小檗碱类和原小檗碱类。前者多为季胺碱，如黄连、黄柏、三颗针中的小檗碱；后者多为叔胺碱，如延胡索中的延胡索乙素。色胺吲哚类（D错）生物碱：含有色胺部分，结构较简单。如吴茱萸中的吴茱萸碱。